行为主义学派认为，人的异常行为、神经症的症状主要是通过什么得来的
A. 外界刺激
B. 生理反应
C. 人的认知
D. 学习过程
E. 遗传因素

正确答案：D。学习过程